能宣肺化痰、止咳平喘的药是
A. 川贝止咳露
B. 百合固金丸
C. 蛇胆川贝液
D. 雪梨膏
E. 芒果止咳片

正确答案：E。芒果止咳片